水体富营养化可能对人体健康产生的直接危害是
A. 影响水的感观性状
B. 导致水俣病
C. 破坏水生生态环境
D. 藻类毒素中毒
E. 可能引起公害病

正确答案：D。藻类毒素中毒

解析：本题考查水体富营养化可能对人体健康产生的直接危害。当含有大量磷、氮的污水进入湖泊、水库、海湾等缓流水体时，可引起藻类及其他浮游生物迅速繁殖，进而导致水体溶解氧量下降，水质恶化，鱼类及其他生物大量死亡，这种水质状况称为水体富营养化。水体富营养化时的藻类大量繁殖不仅可引起水体感官性状的恶化，其藻类毒素（D对ABCE错）还可损伤肝脏等，对人体健康产生直接危害。